真性性早熟为
A. 女童10岁前月经来潮
B. 下丘脑-垂体-卵巢轴功能提前发育
C. 垂体性腺肿瘤引起
D. 女童患颗粒细胞瘤
E. 服用含性激素类药物或保健品，小儿提前性器官发育

正确答案：B。下丘脑-垂体-卵巢轴功能提前发育

解析：本题考查真性性早熟的相关内容。真性性早熟又称完全性、中枢性或GnRH依赖性性早熟，占女性性早熟的80%以上，一些病变或目前尚未明了的因素使下丘脑－垂体－卵巢轴功能提前发育（B对ACDE错），引起促性腺激素和性激素的提早分泌所致。